对于不能耐受较深麻醉，但必须要控制呼吸或人工呼吸者应选用
A. 经鼻盲探插管法
B. 经鼻腔明视插管法
C. 经口盲探气管内插管法
D. 清醒气管内插管法
E. 双腔支气管导管DLT插管术

正确答案：D。清醒气管内插管法

解析：清醒气管内插管法的适应证：1.估计快速诱导插管有一定困难者。2.消化道梗阻或饱食者，以避免麻醉引起胃反流而误吸3.不能耐受较深麻醉，但必须要控制呼吸或人工呼吸者。4.颅脑、开胸等针麻手术。所以对于不能耐受较深麻醉，但必须要控制呼吸或人工呼吸者应选用清醒气管内插管法（D对）。经鼻盲探插管法的适应证：本法主要用于张口确实困难，喉镜难以置人口腔并需呼吸道管理的病人（A错）。经鼻腔明视插管法的适应证：1.口腔、颌面、咽腔手术。2.经口插管有困难者，如张口困难、门齿松动并必须避免损伤者（B错）。经口盲探气管内插管法的适应证：1.部分张口困难但能容下导管和牙垫者。2.呼吸道部分梗阻。3.颈部强直、颈椎骨折脱白等颈部活动受限者。4.颈前瘢痕挛缩严重影响抬头活动者。5.喉结过高、颈部粗短、下颌退缩等特殊病人（C错）。双腔支气管导管插管术的适应证：1.“湿肺”病人全麻手术，如肺脓肿、支气管扩张等。2.开放性肺结核其分泌物有扩散感染能力者。3.支气管胸膜瘘、外伤性支气管断裂者，以健侧肺维持有效通气量和麻醉深度。4.近期有大咯血者（E错）。